臂丛的锁骨上部分支
A. 正中神经
B. 胸背神经
C. 腋神经
D. 锁骨上神经
E. 肩胛上神经

正确答案：E。肩胛上神经

解析：锁骨上分支多为行程较短的肌支，分布于颈深肌群、背部浅层肌（斜方肌除外）、部分胸上肢肌及上肢带肌。其主要分支计有：胸长神经、肩胛背神经、肩胛上神经（E对）。正中神经（A错）、胸背神经（B错）、腋神经（C错）为锁骨下分支。锁骨上神经（D错）为颈丛的分支。